女，53岁。接触性出血1个月。妇科检查：宫颈后唇有一菜花样新生物，接触性出血阳性，宫体大小正常，附件（-）。该患者最可能的诊断是
A. 子宫内膜癌
B. 急性宫颈炎
C. 宫颈肌瘤
D. 宫颈癌
E. 慢性宫颈炎

正确答案：D。宫颈癌

解析：患者为老年女性，出现接触性出血（宫颈癌常表现为接触性出血，即性生活或妇科检查后阴道流血），妇科检查：宫颈后唇有一菜花样新生物（外生型子宫颈癌可见息肉状、菜花状赘生物），接触性出血阳性，宫体大小正常，附件（﹣），最可能的诊断是宫颈癌（D对）。子宫内膜癌（P315）（A错）的常见临床表现为绝经后阴道流血和阴道排液，未绝经者可表现为月经增多及经期延长，月经紊乱。急性宫颈炎（P254）（B错）大部分患者无症状，有症状者主要表现为阴道分泌物增多，呈粘液脓性，伴外阴瘙痒及灼热感。宫颈肌瘤（P310-P311）（C错）主要表现为经量增多及经期延长，妇检可发现宫颈局部有突出肌瘤结节或子宫颈外形的改变。慢性宫颈炎（P255）（E错）多数患者无症状，妇检可发现子宫颈糜烂样改变、息肉或肥大。